PEG-DSPE是一种PEG化脂质材料，常用于对脂质体进行PEG化，增强与单核巨噬细胞的亲和力。盐酸多柔比星脂质体以PEG-DSPE为膜结合的脂质体属于
A. 前体脂质体
B. pH敏感脂质体
C. 免疫脂质体
D. 热敏脂质体
E. 长循环脂质体

正确答案：E。长循环脂质体

解析：本题考查脂质体。盐酸多柔比星脂质体以PEG⁻DSPE为膜结合的脂质体属于长循环脂质体（E对）。PEG修饰可增加脂质体的柔顺性和亲水性，从而降低与单核巨噬细胞的亲和力，延长循环时间。pH敏感脂质体（B错）指对pH敏感的脂质体；免疫脂质体（C错）是表面连接上抗体或抗原的脂质体；热敏脂质体（D错）是利用在相变温度时，脂质体的类脂质双分子层膜从胶态过渡到液晶态，脂质膜的通透性增加，药物释放速度增大的原理制成的脂质体。